下列选项中用于表示后退接触位的是
A. RCP
B. ICP
C. COP
D. MPP
E. MIP

正确答案：A。RCP

解析：后退接触位（RCP），牙尖交错位（ICP），正中（牙合）位（COP），下颌姿势位（MPP），最大牙尖交错位（MIP）。掌握“牙尖交错位、后退接触位与正中关系”知识点。